蛋白酶水解时
A. 一级结构破坏
B. 二级结构破坏
C. 三级结构破坏
D. 四级结构破坏
E. 空间结构破坏

正确答案：A。一级结构破坏